腹痛常见病因病机
A. 寒凝
B. 热结
C. 气滞
D. 气虚
E. 食滞

正确答案：A、B、C、D、E。寒凝；热结；气滞；气虚；食滞

解析：本题考查的是腹痛常见病因病机。腹痛，有虚有实，如寒凝（A对）、热结（B对）、气滞（C对）、气虚（D对）与食滞（E对）。腹痛：腹部分大腹、小腹、少腹三部分。脐以上为大腹，属脾胃；脐以下为小腹，属肾、膀胱、大小肠及胞宫；小腹两侧为少腹，是肝经经脉所过之处。就其疼痛的不同部位，可以察知其所属的不同脏腑。对于腹痛，还需分清虚实，如寒凝、热结、气滞、血瘀、食滞、虫积等，多为实证；至于气虚、血虚、虚寒等，概属虚证。